下列哪种疾病可引起高输出量性心力衰竭？
A. 维生素B1缺乏症
B. 冠心病
C. 肺源性心脏病
D. 风湿性心脏病
E. 高血压病

正确答案：A。维生素B1缺乏症

解析：维生素B1缺乏症（A对）时，外周血管阻力降低，回心血量增加，心脏过度充盈，代偿阶段心排血量明显高于正常，处于高动力循环状态，当前负荷长期过重而进入失代偿期后，心排血量较前下降，但仍不低于正常群体的平均水平，称为高输出量性心力衰竭。冠心病（B错）、肺源性心脏病（C错）、风湿性心脏病（D错）、高血压病（E错）通过降低心肌收缩性或使心脏负荷过重持续影响心功能，当进入失代偿期后，心泵功能减退，心排血量低于正常群体平均水平，称为低输出量性心力衰竭。